阵发性痉咳伴鸡鸣样回声常见于
A. 百日咳
B. 慢性支气管炎
C. 大叶性肺炎
D. 胸膜炎
E. 肺脓肿

正确答案：A。百日咳

解析：咳嗽的音色对提示诊断有一定的意义。百日咳（A对）是一种由百日咳杆菌引起的急性呼吸道传染病，临床特征为咳嗽逐渐加重，呈典型的阵发性痉咳伴鸡鸣样回声。慢性支气管炎（B错）是气管、支气管黏膜及周围组织的慢性非特异性炎症。临床以咳嗽、咳痰为主要症状，每年发病持续3个月，连续2年或2年以上。大叶性肺炎（C错）的患者都伴有高热及咳嗽。胸膜炎（D错）咳嗽的特点是胸部疼痛伴随咳嗽和深呼吸加重。肺脓肿（E错）的患者一般有高热，咳嗽且伴有脓性痰。